上颌前牙髓腔形态没有的是
A. 髓室顶
B. 髓室壁
C. 髓室底
D. 髓室顶和髓室底
E. 以上都不是

正确答案：C。髓室底

解析：本题考查髓腔形态。上颌前牙髓腔形态没有的是髓室底（C对E错）。上颌前牙髓腔形态与相应的牙体外形相似，髓室与根管无明显界限，无髓室底，有髓室顶和髓室壁（ABD错），其特点是根管多为单根管。